男，56岁。因“肺部感染、休克”入监护室治疗。血气分析提示该患者“代谢性酸中毒，Ⅰ型呼吸衰竭”为保护患者组织灌注，此时不宜快速纠正酸中毒，其主要原因在于酸中毒时
A. 组织氧摄取能力增加
B. 血红蛋白结合氧增加
C. 肺部获得更多的氧
D. 组织氧耗量减少
E. 氧离曲线右移

正确答案：E。氧离曲线右移

解析：休克病人不宜快速纠正酸中毒，因为酸中毒时，PH降低，氧离曲线右移，Hb对O₂的亲和力降低，有利于O₂从Hb解离，而碱性环境不利于O₂从Hb解离，会加重组织缺氧。且轻度酸中毒在机体获得充足血容量和微循环得到改善后常可缓解而不需再用碱性药物纠正（E对ABCD错）。